心身疾病是
A. 心理社会因素在病因上起主导作用的躯体疾病
B. 由心理社会因素引起的精神疾病
C. 由心理社会因素引起的器官系统的功能性改变
D. 由心理社会因素引起的神经症
E. 由心理社会因素引起的生理反应

正确答案：A。心理社会因素在病因上起主导作用的躯体疾病